女，15岁。发现贫血黄疸5年。脾肋下2.5cm，质中。血红蛋白90g/L，网织红细胞比例0.05，白细胞和血小板均正常。红细胞渗透压渗透脆性试验：0.7%盐水溶液开始溶血。其父也有轻度黄疸。要明确诊断，最有价值的实验室检查
A. 周围血片
B. 骨髓象
C. 血清铁总结合力
D. 血红蛋白电泳
E. 肝功能试验

正确答案：A。周围血片

解析：患者诊断为遗传性球形细胞增多症，外周血小球形红细胞增多（大于10%）是遗传性球形细胞增多症的特征，故周围血片是最有价值的实验室检查（A对）。骨髓象（B错）主要用于再障、急性白血病的诊断，对确诊贫血类型及病因意义不大；血清总铁结合力（P542）（C错）主要用于缺铁性贫血的诊断；血红蛋白电泳（P556）（D错）主要用于海洋性贫血的诊断；肝功能试验（E错）无特异性。